普鲁卡因和琥珀胆碱联用时，会加重呼吸抑制的不良反应，其可能的原因是
A. 个体遗传性血浆胆碱酯酶活性低下
B. 琥珀胆碱与普鲁卡因发生药物相互作用；激活胆碱酯酶的活性，加快琥珀胆碱代谢
C. 普鲁卡因竞争胆碱酯酶，影响琥珀胆碱代谢，导致琥珀胆碱血药浓度增高
D. 普鲁卡因抑制肝药酶活性，进而影响了琥珀胆碱的代谢，导致琥珀胆碱血药浓度增高
E. 琥珀胆碱影响尿液酸碱性，促进普鲁卡因在肾小管的重吸收，导致普鲁卡因血药浓度增高

正确答案：C。普鲁卡因竞争胆碱酯酶，影响琥珀胆碱代谢，导致琥珀胆碱血药浓度增高

解析：本题考查影响药物代谢的作用形式。普鲁卡因和琥珀胆碱联用时，会加重呼吸抑制的不良反应，其可能的原因是普鲁卡因竞争胆碱酯酶，影响琥珀胆碱代谢，导致琥珀胆碱血药浓度增高（C对）。有些药物在体内通过各自的灭活酶而被代谢，这些灭活酶若被抑制，将加强相应药物的作用。在静脉滴注普鲁卡因进行全身麻醉期间，加用骨骼肌松弛药琥珀胆碱要特别慎重，因二者均被胆碱酯酶代谢灭活，大量滴注入体内的普鲁卡因将与琥珀胆碱竞争胆碱酯酶，影响琥珀胆碱的水解灭活，加重琥珀胆碱的呼吸抑制作用。